对儿童进行乙肝型肝炎疫苗接种的临床试验研究，为评价其流行病学预防效果，最好选用的指标是
A. 效果指数
B. 发病率
C. 感染率
D. 死亡率
E. 病死率

正确答案：A。效果指数

解析：疫苗效果评价包括两种，分别是免疫学效果评价和流行病学效果评价，前者是通过接种后人群抗体阳转率、抗体评价滴度和抗体持续时间进行评价。后者是根据同期随机对照双盲试验结果，计算疫苗保护率和效果指数进行评价（A对）。